患者右眼上睑下垂，CT示右胸顶部三厘米的圆影，边缘界限清楚。诊断为
A. 畸胎瘤
B. 重症肌无力
C. 神经性肿瘤
D. 胸腺瘤
E. 胸骨后甲状腺瘤

正确答案：D。胸腺瘤

解析：该患者出现右眼上睑下垂（合并肌无力症状），CT示右胸顶部（位于前上纵隔）三厘米的圆影，边缘界限清楚，根据患者表现和影像学检查，诊断为胸腺瘤（D对B错）。